急性一氧化碳中毒损害的主要系统是
A. 中枢神经系统
B. 心血管系统
C. 呼吸系统
D. 血液系统
E. 消化系统

正确答案：A。中枢神经系统

解析：本题考查急性一氧化碳中毒症状。急性一氧化碳中毒是吸入较高浓度一氧化碳后引起的急性脑缺氧性疾病，起病急骤、潜伏期短，主要表现为急性脑缺氧引起的中枢神经损害（A对BCDE错）。少数病人可有迟发性神经精神症状，部分病人也可有其他脏器的缺氧性改变。中毒程度与血中HbCO浓度有关。